祛风湿药物的主要药理作用是
A. 抗炎
B. 镇静
C. 利尿
D. 解热
E. 利胆

正确答案：A。抗炎

解析：本题考查的是祛风湿药的药理作用。祛风湿药物的主要药理作用是抗炎（A对）。祛风湿药的药理作用包括1.抗炎作用2.镇痛作用。